不用于治疗膀胱过度活动症的M胆碱受体阻断药是
A. 奥昔布宁
B. 黄酮哌酯
C. 托特罗定
D. 索利那新
E. 东莨菪碱

正确答案：E。东莨菪碱

解析：本题考查M胆碱受体阻断药的临床应用。东莨菪碱（E错，为本题正确答案）用于胃肠道痉挛、胆绞痛、肾绞痛、胃肠道蠕动亢进等。治疗膀胱过度活动症的M胆碱受体阻断药包括奥昔布宁（A对）、黄酮哌酯（B对）、托特罗定（C对）、索利那新（D对）。